在使用辅助检查手段时，不适宜的是
A. 认真严格地掌握适应证
B. 可以广泛积极地依赖各种辅助检查
C. 有利于提高医生诊治疾病的能力
D. 必要检查能尽早确定诊断和进行治疗
E. 应从患者的利益出发决定该做的项目

正确答案：B。可以广泛积极地依赖各种辅助检查

解析：使用辅助检查手段时，认真严格的掌握适应证是必须首先要遵守的（A对）。完全依赖辅助检查来对疾病进行诊断（B错，为本题正确答案）不符合医德的要求，是应该阻止的行为。必要的检查能尽早确定诊断和进行治疗（D对），并且有利于提高医生诊治疾病的能力（C对）。医生应从患者的利益出发决定该做的项目（E对）。